男，35岁。右下肢疼痛1年。让其抬高右下肢80°，1分钟后下肢皮肤苍白，再让其下肢垂于床沿，大约1分钟后下肢皮肤颜色方恢复正常。该检查结果提示
A. Buerger试验阳性
B. Trendelenburg试验阳性
C. Perthes试验阳性
D. Prantt试验阳性
E. lasegue试验阳性

正确答案：A。Buerger试验阳性

解析：该检查结果提示Buerger试验阳性（A对）。Buerger试验亦称体位色泽改变试验。检查方法如下：现将下肢抬高70°～80°，持续1分钟，正常肢体远端皮肤保持淡红或稍微苍白，若呈苍白或蜡白色，提示动脉供血不足；再将下肢下垂于床沿，正常人皮肤色泽可在10秒内恢复，若恢复时间超过45秒，且色泽不均者，进一步提示动脉供血障碍。浅静脉瓣膜功能（Trendelenurg）试验（B错）：病人平卧，抬高患肢使静脉排空，在大腿根部扎止血带，阻断大隐静脉，然后让病人站立，迅速释放止血带。若出现自上而下的静脉逆向充盈，即为阳性，提示瓣膜功能不全。深静脉通畅（Perthes）试验（C错）：患者站立，在患肢大腿上1/3处扎止血带，阻断大隐静脉回流，然后嘱患者交替伸屈膝关节10～20次，以促进下肢血液回流。若活动后浅静脉曲张更加明显，张力增高，甚至胀痛，即为阳性，提示深静脉阻塞，禁忌作大隐静脉高位结扎术。Pratt试验（D错）为交通静脉瓣膜功能试验。检查方法如下：病人仰卧，抬高下肢，在大腿根部扎上止血带，然后从足趾向上至腘窝缠缚第一根弹力绷带，再自止血带处向下，缠绕第二根弹力绷带；让病人站立，一边向下解开第一根弹力绷带，一边向下缠缚第二根弹力绷带。若在两绷带之间出现曲张静脉，即提示该处有功能不全的交通静脉。Lasegue试验（E错）又称直腿抬高试验（P733）：患者双下肢伸直仰卧，检查者一手扶住患者膝部使其膝关节伸直，另一手握住踝部并徐徐将之抬高，直至患者产生下肢放射痛为止。若抬高在60°以内即出现坐骨神经痛，即为阳性，提示可能存在腰椎间盘突出。